下列各项，不属于流行性出血热发热期治疗原则的是
A. 控制感染
B. 减轻外渗
C. 透析疗法
D. 改善中毒症状
E. 预防DIC

正确答案：C。透析疗法

解析：流行性出血热发热期治疗原则的是抗病毒（A对）、减轻外渗（B对）、改善中毒症状（D对）和预防DIC（E对）。透析疗法（C错，为本题正确答案）为流行性出血热少尿期的治疗原则。